下列关于“实”的叙述，错的是
A. 外感邪盛
B. 肌肤经络闭塞
C. 气机升降失调
D. 脏腑功能亢进
E. 气血壅滞瘀结

正确答案：C。气机升降失调

解析：实，指邪气盛，是以邪气亢盛（A对）为矛盾主要方面的一种病理变化。即邪气的致病力强盛，而正气的抗病能力未衰，能积极与邪抗争，故正邪相搏，斗争激烈，反应明显，临床上出现一系列病理性反应比较剧烈的、有余的证候即脏腑功能亢进（D对），称为实证。临床上，外感病实证邪盛常见壮热、狂躁、声高气粗、腹痛拒按、二便不通、脉实有力、舌苔厚腻等一系列肌肤经络闭塞的症（B对）；而内伤病实证则表现为痰涎壅盛、食积不化、水湿泛滥、气滞血瘀（E对）等各种病变。气机升降失调，既有可能是实证导致的气机紊乱，也可能是虚证导致的阳气不举（C错，为本题正确答案）。